党参粉末不具备的显微特征是
A. 乳管碎片
B. 菊糖
C. 淀粉粒
D. 树脂道碎片
E. 石细胞

正确答案：D。树脂道碎片

解析：本题考查的是党参的显微鉴别。党参粉末不具备的显微特征是树脂道碎片（D错，为本题正确答案）。党参【显微鉴别】横切面：木栓细胞数列至10数列，外侧有石细胞，单个或成群。皮层窄。韧皮部宽广，外侧常现裂隙，散有淡黄色乳管群，并常与筛管交互排列。形成层成环。木质部导管单个散在或数个相聚，呈放射状排列。薄壁细胞含菊糖。皮层和韧皮薄壁细胞中含淀粉粒（C对）。粉末：淡黄色。石细胞（E对）呈方形、长方形或多角形，壁不甚厚。木栓细胞表面观呈类多角形，垂周壁薄，微弯曲。菊糖（B对）众多，用水合氯醛装片不加热观察，可见菊糖结晶呈扇形，表面现放射状纹理。节状乳管碎片（A对）甚多，含淡黄色颗粒状物，直径16～24㎛。网纹导管易察见。